抑制龋齿发生效果最好的糖代用品是
A. 糖精
B. 山梨醇
C. 木糖醇
D. 甘露醇
E. 蛋白糖

正确答案：C。木糖醇

解析：木糖醇等糖的替代品不会被致龋菌利用产酸和形成多聚糖，通常作为甜味剂被使用。但在实际生活中，糖代用品还不能完全代替蔗糖，因此，控制食糖频率及吃糖后及时清洁口腔，减少糖在口腔内的滞留时间尤为重要。掌握“龋病三级预防”知识点。